乳上颌前牙釉质表面产生了呈新月形的龋损，称为
A. 线性釉质龋
B. 平滑面龋
C. 静止性龋
D. 浅龋
E. 慢性龋

正确答案：A。线性釉质龋

解析：线性釉质龋是一种非典型性龋病损害，乳上颌釉质表面的新生带部位产生的龋病病损呈新月形，其后续牙对龋病的易感性也较强。掌握“龋病的临床表现与分类”知识点。